下列关于被覆黏膜叙述错误的是
A. 黏膜表层无角化，富有弹性
B. 上皮与结缔组织交界面凹凸不平
C. 颊黏膜有时可出现成簇的粟粒状淡黄色小颗粒
D. 被覆黏膜富有弹性，有一定的活动度
E. 上皮一般较咀嚼黏膜厚

正确答案：B。上皮与结缔组织交界面凹凸不平

解析：咀嚼黏膜和特殊黏膜外的口腔黏膜均称被覆黏膜。黏膜表层无角化，富有弹性，可承受张力。上皮一般较咀嚼黏膜厚，结缔组织乳头短而粗，上皮与结缔组织交界面较平坦。被覆黏膜富有弹性，有一定的活动度，有较疏松的黏膜下层。颊黏膜的口角后部的区域有时可出现成簇的粟粒状淡黄色小颗粒，即异位增生的皮脂腺，称为福代斯斑。掌握“口腔黏膜基本结构”知识点。